根据行为改变阶段的模式，对于问题尚无了解的患者，应采取的措施是
A. 提供信息，提高认识
B. 提高认识，激发动机
C. 提供方法，鼓励尝试
D. 支持鼓励，加以强化
E. 不断强化，预防复发

正确答案：A。提供信息，提高认识

解析：行为转变理论模式，也称为行为阶段转变理论模型（TTM） ，它着眼于行为变化过程及对象需求，理论基础是社会心理学。它认为人的行为转变是一个复杂、渐进、连续的过程，可分为5个不同的阶段，即没有准备阶段、犹豫不决阶段、准备阶段、行动阶段和维持阶段。在没有准备阶段，患者对问题尚无了解，没有形成意图，因此应该采取的措施是，提供信息，提高认识（A对），使患者形成解决问题的意图，从而促使行为改变。